芒果止咳片的功能是
A. 清肺润燥，止咳化痰
B. 降气平喘，止咳化痰
C. 祛风解热，止咳化痰
D. 宣肺化痰，止咳平喘
E. 解表散寒，宣肺止嗽

正确答案：D。宣肺化痰，止咳平喘